有机磷农药中毒时，应用胆碱酯酶复活剂应注意
A. 中毒已超过3日或慢性中毒患者，复活剂剂量加倍
B. 中度中毒时，复活剂不应稀释且需快速注射
C. 重度中毒时，应立即采用大剂量突击疗法，以控制中毒症状
D. 不能与酸性药物配伍，以免影响药物稳定性
E. 切勿二种或三种复活剂同时应用，以免其毒性增加

正确答案：E。切勿二种或三种复活剂同时应用，以免其毒性增加

解析：本题考查有机磷中毒解救。应用胆碱酯酶复活剂的注意事项：有机磷农药中毒时，应用胆碱酯酶复活剂应注意切勿二种或三种复活剂同时应用，以免其毒性增加（E对）。对复活剂有效的有机磷农药或杀虫剂中毒，除要尽早应用外，须根据中毒程度，给予合理的剂量和应用时间。复活剂用量过大、注射过快或未经稀释直接注射，均可引起中毒，须特别注意（ABC错）。由于此类药物在碱性溶液中不稳定，可以水解生成剧毒的氮化物，故不能与碱性药物合用（D错）。